虚劳，口干唇燥，不思饮食，大便燥结，甚则干呕，呃逆，面色潮红，舌干，少苔或无苔，脉细数。其证候是
A. 心阴虚
B. 肝阴虚
C. 脾胃阴虚
D. 肺阴虚
E. 肾阴虚

正确答案：C。脾胃阴虚

解析：患者虚劳，津亏不能上承，则口干唇燥；脾胃阴虚，运化失常，故见不思饮食；胃肠失于滋润故见大便燥结；阴亏较甚，胃气失于和降，则干呕，呃逆，面色潮红；舌干，少苔或无苔，脉细数，均为脾胃阴虚证（C对）。心阴虚证（A错）的特点为心悸，失眠，烦躁，潮热，盗汗，或口舌生疮，面色潮红。肝阴虚（B错）的特点为头痛，眩晕，耳鸣，目干畏光，视物不明急躁易怒，肢体麻木，筋惕肉瞤。肺阴虚（D错）的特点为干咳，咽燥，甚或失音，咳血，潮热，盗汗，面色潮红。肾阴虚（E错）的特点为腰酸，遗精，两足软弱，眩晕，耳鸣，甚则耳聋，口干，咽痛。